女，45岁。发热、咳嗽、咳脓痰3天。胸部X线片示右上肺大片状阴影，其内可见多个透亮区，叶间裂略下移。该患者最可能的诊断是
A. 肺脓肿
B. 金葡菌肺炎
C. 肺结核
D. 肺炎链球菌肺炎
E. 肺炎克雷伯杆菌肺炎

正确答案：E。肺炎克雷伯杆菌肺炎

解析：中年女性患者，发热、咳嗽、咳脓痰（发热、咳嗽咳痰是肺炎的常见症状），胸部X片示：右上肺大片状阴影，内有多个透亮区，叶间裂略下移（叶间裂下移是肺炎克雷伯杆菌肺炎的典型X线表现），综合患者的症状、体征及X线征象，该患者最可能的诊断是肺炎克雷伯杆菌肺炎（E对）。肺脓肿（P59）（A错）早期X线表现为大片浓密模糊的浸润性阴影，边缘不清；肺脓肿形成后，脓腔出现圆形透亮区及气液平面，内壁光整或略有不规则。金葡菌肺炎（B错）X线表现为肺叶或小叶浸润，早期空洞、脓胸，可见液气囊腔。肺结核（P65）（C错）起病较缓，常有低热、盗汗、食欲不振等全身中毒症状，X线特点是病变多发生在上叶的尖后段、下叶的背段和后基底段，呈多态性，密度不均匀、边缘较清楚和病变变化较慢，易形成空洞和播散病灶。肺炎链球菌肺炎（D错）X线征象为肺叶或肺段实变，无空洞，可伴有胸腔积液。